吗啡急性中毒的表现是
A. 便秘
B. 针尖样瞳孔
C. 呕吐
D. 耐受性
E. 依赖性

正确答案：B。针尖样瞳孔

解析：吗啡急性中毒的主要表现为昏迷、针尖样瞳孔（B对）、呼吸高度抑制、血压降低，甚至休克。